肾动脉狭窄者慎用
A. 巯甲丙脯酸（开搏通）
B. 环磷酰胺
C. 低分子肝素
D. 甲泼尼龙（甲基强的松龙）
E. 呋塞米（速尿）

正确答案：A。巯甲丙脯酸（开搏通）

解析：巯甲丙脯酸（开搏通）（A错，为本题正确答案）就是卡托普利，为血管紧张素转换酶抑制剂（ACEI），若患者存在肾动脉狭窄，ACEI能加重肾功能损伤，升高血浆肌酐浓度，甚至产生氮质血症。这是因为血管紧张素Ⅱ能可通过收缩出球小动脉维持肾灌注压，血管紧张素转换酶抑制剂舒张出球小动脉，降低肾灌注压，导致肾滤过率与肾功能降低（九版药理学P204）。因此肾动脉狭窄者慎用巯甲丙脯酸（开搏通）。环磷酰胺（九版药理学P447）（B对）是最常用的烷化剂类抗肿瘤药，可干扰DNA及RNA合成；低分子肝素（P233）（C对）为急性冠状动脉综合征的常规抗凝药物；甲泼尼龙（甲基强的松龙）（D对）是肾上腺皮质激素类药，主要用于过敏性与炎症性疾病；呋塞米（速尿）（E对）是作用于髓袢升支粗段的强效利尿剂，这四种药物均无引起血管痉挛，加重肾动脉狭窄程度的副作用，可用于肾动脉狭窄者。